易患根面龋的人群是
A. 婴儿
B. 幼儿
C. 老年人
D. 中年人
E. 学龄前期

正确答案：C。老年人

解析：本题考查老年人口腔健康问题。易患根面龋的人群是老年人（C对）。老年人口腔健康问题：1.牙龈退缩和根面龋：生理性牙龈萎缩造成牙龈退缩，牙间隙增大易发生水平型食物嵌塞。牙龈退缩造成牙根暴露，牙颈部和根面极易发生龋损，导致根面龋的发生，并可伴发牙本质敏感。老年人由于唾液分泌量减少，自洁作用差，可加重根面龋的进程。2.牙列缺损和缺失：龋病与牙周病是造成老年人牙缺失的主要原因。3.口腔黏膜病和口腔癌。4.牙磨耗和楔状缺损。行首次口腔检查应在婴儿（A错）。第一恒磨牙窝沟封闭的适宜人群是学龄前期（E错）。